以PEG6000为滴丸基质时，可用作冷凝液的是
A. β-环糊精
B. 液状石蜡
C. 羊毛脂
D. 七氟丙烷
E. 硬脂醇

正确答案：B。液状石蜡

解析：本题考查滴丸剂。液状石蜡（B对）与PEG6000互不作用、不相混溶，可以用作冷凝液。β-环糊精（A错）的空腔结构可与小分子化合物通过非共价键的分子间相互作用形成主-客体包合物；羊毛脂（C错）为优良的软膏基质及油包水型乳剂的乳化剂；七氟丙烷（D错）是一种以化学灭火为主兼有物理灭火作用的洁净气体化学灭火剂；硬脂醇（E错）为生物溶蚀性骨架材料。